结核菌素试验72小时注射部位出现红肿硬结直径20mm并出现水疱坏死，判断结果是
A. “-”
B. “±”
C. “+”
D. “++”
E. “+++”

正确答案：E。“+++”

解析：结核菌素试验72小时注射部位出现红肿硬结直径20mm并出现水疱坏死，判断结果是强阳性（+++）（E对）。“-”（A错）为阴性，无硬结或硬结平均直径＜5mm者。“+”（C错）为一般阳性，皮肤硬结直径5～9mm。“++”（D错）为中度阳性反应，皮肤硬结直径10～19mm。